高胆固醇，低密度脂蛋白偏高，治疗选用
A. 他汀类药物
B. 贝特类
C. 烟酸类
D. 普罗布考
E. 依折麦布

正确答案：A。他汀类药物

解析：贝特类药物和烟酸类以降低甘油三酯为主（BC错）；普罗布考对低密度脂蛋白的作用不大（D错）。